含有儿茶酚胺结构的药物是
A. 盐酸异丙肾上腺素
B. 盐酸麻黄碱
C. 盐酸普萘洛尔
D. 盐酸哌唑嗪
E. 硫酸沙丁胺醇

正确答案：A。盐酸异丙肾上腺素